盐酸普鲁卡因含量测定所使用的滴定液是
A. 高氯酸滴定液
B. 亚硝酸钠滴定液
C. 氢氧化钠滴定液
D. 盐酸滴定液
E. 硝酸银滴定液

正确答案：B。亚硝酸钠滴定液

解析：本题考查亚硝酸钠滴定法。盐酸普鲁卡因含量测定所使用的滴定液是亚硝酸钠滴定液（B对）。盐酸普鲁卡因分子结构中含有芳香伯胺，《中国药典》2020年版采用亚硝酸钠滴定法进行含量测定，用永停法指示终点。方法：取本品约0.6g，精密称定，照永停滴定法，在15～25℃用亚硝酸钠滴定液（0.1mol/L）滴定。非水碱量法是以冰醋酸或冰醋酸-醋酐为溶剂，用高氯酸的冰醋酸溶液（A错）为滴定液滴定。氢氧化钠滴定（C错）和盐酸滴定（D错）均属于酸碱滴定法，适用于一般的酸、碱以及能与酸、碱直接或间接发生质子转移的物质。硝酸银滴定（E错）常用于沉淀滴定法，是利用银离子与卤素离子反应或银离子产生沉淀来测定含量。